患者小便涓滴不通，烦渴欲饮，咽干，呼吸短促，咳嗽，舌苔薄黄，脉数。其治法是
A. 行瘀散结，通利水道
B. 疏调气机，通利小便
C. 清泄肺热，通利水道
D. 清热利湿，通利小便
E. 升清降浊，化气利水

正确答案：C。清泄肺热，通利水道

解析：患者小便涓滴不通，故诊断为癃闭；肺热壅盛，失于肃降，不能通调水道，下输膀胱，故小便涓滴不畅；肺热上壅，气逆不降，故呼吸短促，咳嗽；烦渴欲饮，咽干，舌苔薄黄，脉数，均是里热内郁之征，故其证候为肺热壅盛证，治以清泄肺热，通利水道，代表方为清肺饮（C对）。行瘀散结，通利水道，是癃闭之浊瘀阻塞证的治法（A错）。疏调气机，通利小便，是癃闭之肝郁气滞证(B错)。清热利湿，通利小便，是癃闭之膀胱湿热证（D错）。升清降浊，化气利水，是癃闭之脾气不升证（E错）。